真核生物染色体DNA三级结构DNA双链盘绕的核心为
A. H2A,H2B，H3,H4分子
B. H3A,H2B，H2,H4分子
C. H2A,H3B，H3,H4分子
D. H3A,H2B，H3,H4分子
E. H2A,H4B，H3,H4分子

正确答案：A。H2A,H2B，H3,H4分子

解析：真核生物染色体DNA成线性，其三级结构是DNA双链进一步盘绕在以组蛋白（H2A,H2B，H3,H4分子）为核心的结构表面构成核小体。掌握“DNA”知识点。